Ⅰ型超敏反应的发生机制中致敏是指
A. 进入机体的变应原刺激B细胞产生的特异性IgE抗体
B. 进入机体的变应原刺激B细胞产生的特异性IgA抗体
C. 进入机体的变应原刺激B细胞产生的特异性IgM抗体
D. 进入机体的变应原刺激T细胞产生的特异性IgE抗体
E. 进入机体的变应原刺激T细胞产生的特异性IgA抗体

正确答案：A。进入机体的变应原刺激B细胞产生的特异性IgE抗体

解析：致敏：进入机体的变应原刺激B细胞产生的特异性IgE抗体。该IgE抗体以其Fc段与肥大细胞或嗜碱性粒细胞表面的FcεRⅠ结合，这种结合累积到一定程度，机体就进入了致敏状态。致敏状态可维持数月甚至更长。掌握“概述及Ⅰ型超敏反应”知识点。